女，68岁。右膝关节疼痛8年，加重伴活动受限1年。查体：右膝关节内翻屈曲挛缩畸形。X线检查示右膝内侧关节间隙狭窄，髌骨关节面不平整。首选治疗方法是
A. 胫骨高位截骨术
B. 口服非甾体类抗炎药
C. 人工膝关节置换术
D. 膝关节融合术
E. 关节镜下清理术

正确答案：C。人工膝关节置换术

解析：患者老年女性，右膝疼痛8年、右膝关节内翻屈曲挛缩畸形（膝关节骨关节炎典型表现），X线片见右膝内侧关节间隙狭窄，髌骨关节面不平整（提示有关节软骨和关节面的破坏），结合患者的症状、体征和影像学检查，该患者最可能的诊断为右膝关节骨关节炎。由于患者年龄较大，疼痛明显，且已有内翻屈曲挛缩畸形，髌骨关节面不平整，严重影响下肢功能，故该患者首选治疗方法是人工膝关节置换术（C对）。胫骨高位截骨术（A错）、膝关节融合术（D错）、关节镜下清理术（E错）多用于早期症状较轻的患者。口服非甾体类抗炎药（B错）为骨关节炎的非手术治疗方法，适用于初诊、症状较轻的患者。